属于理论流行病学
A. 现患调查
B. 病例对照研究
C. 观察某种药物治疗的疗效
D. 将调查数据建立流行病学数学模型
E. 基础实验室检查

正确答案：D。将调查数据建立流行病学数学模型

解析：本题考查理论流行病学的分类。理论流行病学主要是将调查数据建立流行病学数学模型（D对）的方法。现患调查（A错）又称现况调查，属于描述性研究；病例对照研究（B错）属于分析性研究；观察某种药物治疗的疗效（C错）属于实验流行病学的范畴；基础实验室检查（E错）属于检测手段，不是流行病学的特有的研究方法。